“肾为气之根”主要指
A. 肾为五脏阳气之根本
B. 肾主纳气，以维持呼吸深度
C. 肾主膀胱的气化开阖
D. 肾主水液的蒸腾气化
E. 元气有肾精所化生

正确答案：B。肾主纳气，以维持呼吸深度

解析：肺司呼吸，呼气赖肺气宣发，吸气赖肺气肃降；但吸气维持一定的深度，除肺气肃降作用外，还有赖于肾气的摄纳潜藏。肺吸入之气，应下纳于肾，也就是说肺的呼吸功能需靠肾气主纳的作用来协助，只有肾中精气充盛，吸入之气才能经过肺的肃降下纳于肾，故称"肾为气之根"（B对）。膀胱的气化（C错），水液的蒸腾（D错），属于肾主气化的功能。元气的化生（E错），肾为五脏阳气之根本（A错）属于肾主藏精的功能。